确诊流脑的依据是
A. 流行季节
B. 突然发病、高热、头痛、呕吐
C. 脑膜刺激征阳性
D. 皮肤瘀点检菌阳性
E. 脑脊液为典型化脓性脑膜炎改变

正确答案：D。皮肤瘀点检菌阳性

解析：流行性脑脊髓膜炎简称流脑。是由脑膜炎双球菌引起的化脓性脑膜炎。临床表现为发热、头痛、呕吐、皮肤粘膜瘀点，瘀斑及颈项强直等脑膜刺激征。皮肤瘀点处的组织液或离心沉淀后的脑脊液做涂片染色（D对），阳性率约60%～80%，瘀点涂片简单易行，应用抗生素早期亦可获得阳性结果，是早期诊断的重要方法。流行季节（A错）为流脑的流行特征，突然发病高热头痛呕吐（B错）、脑膜刺激征阳性（C错）为流脑的临床表现，皮肤瘀点检菌阳性（D对）为流脑实验室检查表现。脑脊液为典型化脓性脑膜炎改变（E错）不能确诊流脑，其他化脓性细菌也会有脑脊液为典型化脓性脑膜炎改变。